男性，12岁，2天前碰伤右上中切牙，牙轻度松动，自觉有伸长感，检查牙髓活力试验同正常牙，轻叩痛，无咬合创伤。诊断为
A. 牙震荡
B. 牙周炎
C. 牙髓坏死
D. 牙轻度脱位
E. 根折

正确答案：A。牙震荡

解析：本题考查牙震荡。男性，12岁，2天前碰伤右上中切牙，牙轻度松动，自觉有伸长感，检查牙髓活力试验同正常牙，轻叩痛，无咬合创伤。诊断为牙震荡（A对）。牙震荡是牙周的轻度损伤，通常不伴牙体组织的缺损。牙震荡临床表现为伤后患牙有伸长不适感，轻微松动和叩痛，龈缘还可有少量出血，说明牙周膜有损伤。若做牙髓活力测验，其反应不一。通常受伤后无反应，而在数周或数月后反应开始恢复。3个月后仍有反应的牙髓，则大多数能继续保持活力，伤后一开始牙髓活力测验有反应的患牙，若后来转变成无反应，则表示牙髓己发生坏死，同时牙可变色。